诊断试验和筛检试验的评价步骤不包括
A. 确定金标准
B. 确定样本含量
C. 非盲法测试
D. 盲法同步测试
E. 选择研究对象

正确答案：C。非盲法测试

解析：诊断试验和筛检试验的评价的步骤有：①确定金标准（目前被公认的最可靠、最权威的、可以反映有病或无病实际情况的诊断方法称为金标准）；②选择研究对象；③确定样本含量：④盲法同步测试；⑤整理分析资料；⑥质量控制。掌握“流行病的诊断和筛检试验及疾病监测”知识点。